舌红绛而光者，属
A. 阴虚
B. 气虚
C. 血虚
D. 气阴两虚
E. 水涸火炎

正确答案：E。水涸火炎

解析：舌红绛而光者，即红绛舌与光滑舌并见。红绛舌多因阴虚水涸，虚火上炎于舌络所致；光滑舌多因胃阴枯竭、胃气大伤，毫无生发之气所致。故舌红绛而光者，属水涸火炎（E对）。红舌，可主阴虚，多因阴液亏乏，虚火上炎所致（A错）。舌色淡白而舌体胖大者，多因气虚、阳虚、津液内停所致，故气虚可见舌淡白而有胖大（B错）。舌淡白而有裂纹者，多因血虚不能上荣于舌，精微不能濡养舌体所致，故血虚可见舌淡白而有裂纹（C错）。气阴两虚，即气虚与阴虚并见。舌质淡红而舌边有齿痕者，多为脾虚或气虚所致；舌色鲜红，多为阴虚所致（D错）。